致依赖性药物包括
A. 可待因
B. 地西泮
C. 氯胺酮
D. 哌替啶
E. 普仑司特

正确答案：A、B、C、D。可待因；地西泮；氯胺酮；哌替啶

解析：本题考查致依赖性药物。致依赖性药物包括：可待因（A对）、地西泮（B对）、氯胺酮（C对）、哌替啶（D对）。致依赖性药物主要包括：（1）麻醉药品；（2）精神药品；（3）其他。依据《麻醉药品目录》的规定，麻醉药品是指连续使用后易产生身体依赖性、能成瘾的药品，临床上使用的阿片类药属于麻醉药品。精神药品是指直接作用于中枢神经系统，使之兴奋或抑制，连续使用能产生依赖性的药品，包括兴奋剂、致幻剂、镇静催眠剂等。可待因和哌替啶属于阿片类麻醉药品。地西泮属于苯二氮䓬类镇静催眠药。氯胺酮为致幻剂。普仑司特（E错）属于作用于白三烯受体的平喘药，不属于致依赖性药物。